氟牙症的病变程度与摄入氟的量和时间的关系为
A. 与摄入氟的量呈正相关，与时间呈负相关
B. 与摄入氟的量呈正相关，与时间呈正相关
C. 与摄入氟的量负正相关，与时间呈负相关
D. 与摄入氟的量呈负相关，与时间呈正相关
E. 与摄入氟的量呈负相关，与时间呈负相关

正确答案：B。与摄入氟的量呈正相关，与时间呈正相关

解析：氟牙症病变严重程度与摄取氟的剂量、时间呈正相关。掌握“氟牙症、先天性梅毒牙与牙本质形成缺陷”知识点。